静力作业时肌肉的主要收缩方式是
A. 等长收缩
B. 等张收缩
C. 等长和等张收缩
D. 间断性收缩
E. 持续性收缩

正确答案：A。等长收缩

解析：本题考查静力作业肌肉收缩方式。静力作业又叫静态作业，主要依靠肌肉等长性收缩（A对BCDE错）来维持体位，使躯体和四肢关节保持不动所进行的作业。静态作业时人没有进行做功。